实验流行病学
A. 从果推因
B. 从因求果
C. 两者均是
D. 两者均否

正确答案：B。从因求果

解析：本题考查实验流行病学的概念。实验流行病学是指研究者根据研究目的，按照预先确定的研究方案将研究对象随机分配到实验组和对照组，人为地施加或减少某种处理因素，然后追踪观察处理因素的作用结果，比较和分析两组人群的结局，从而判断处理因素的效果。实验流行病学是一种由因及果（B对ACDE错）的研究方法。